某医院住院病房某日调配雷尼替丁片（150mg/片，30片/盒）5盒用于治疗消化性溃疡，雷尼替丁治疗消化性溃疡的限定日剂量（DDD）值是300mg，则预计该日使用该药的用药人次数是
A. 25
B. 50
C. 75
D. 100
E. 125

正确答案：C。75

解析：本题考查药物用量计算。用药人次数＝药物总用量÷限定日剂量，即用药人次数=150mg/片×30片/盒×5盒÷300mg＝75（人次）（C对）。